某患者因肺部感染入院，经多种抗菌药物治疗效果不明显。主治医师刘某值夜班时发现患者病情危重，需要使用特殊使用级抗菌药物治疗。依照《抗菌药物临床使用管理办法》规定，刘某越级使用了抗菌药物，同时详细记录用药指征，并在规定时限内补办了越级使用抗菌药物的必要手续。该时限是
A. 12小时
B. 3小时
C. 24小时
D. 6小时
E. 2小时

正确答案：C。24小时

解析：依照《抗菌药物临床使用管理办法》规定，因因抢救生命垂危的患者等紧急情况，医师可以越级使用抗菌药物。越级使用抗菌药物应当详细记录用药指征，并应当于24小时（C对）内补办越级使用抗菌药物的必要手续。